清代的本草代表作是
A. 《本草纲目》
B. 《证类本草》
C. 《新修本草》
D. 《本草纲目拾遗》
E. 《本草经集注》

正确答案：D。《本草纲目拾遗》

解析：本题考查历代本草代表作。清代的本草代表作是《本草纲目拾遗》（D对）。《本草纲目拾遗》：简称《纲目拾遗》，为清代本草代表作。作者赵学敏在广泛收集民间用药和注意研究外来药的基础上撰成此书。全书共10卷，载药921种，其中新增716种，创古本草增收新药之冠，极大地丰富了本草学。同时，对《本草纲目》略而不详的加以补充，错误的加以订正，不但总结了16～18世纪本草学发展的新成就，而且还保存了大量今已散佚的方药书籍的部分内容，具有很高的实用价值和文献价值。《本草纲目》（A错）：简称《纲目》，为明代本草代表作。该书的作者为伟大医药学家李时珍。该书不仅集我国16世纪以前药学成就之大成，将本草学的发展提高到一个空前的高度，而且在生物、化学、天文、地理、地质、采矿等方面也有突出的成就，对世界医药学和自然科学的许多领域做出了举世公认的卓越贡献。《经史证类备急本草》：简称《证类本草》（B错），为宋金元时期宋代的本草代表作。作者唐慎微，以掌禹锡的《嘉祐本草》和苏颂的《图经本草》为基础，并收集转录了大量宋以前各代名医对本草的真知灼见、经史传记和佛书道藏中有关本草的论述，以及民间防治疾病的经验和单方，撰成此书。该书图文对照，方药并收，医药结合，资料翔实，集宋以前本草之大成，使大量古代文献得以保存，具有极高的学术价值和文献价值。《新修本草》（C错）：又称《唐本草》，为隋唐时期唐代的本草代表作。该书是在普查全国药材基础上，由长孙无忌、李勣、苏敬等22人共同编撰而成。本书的完成依靠了国家的行政力量和充足的人力物力，是我国历史上第一部官修药典性本草，并被今人誉为世界上第一部药典，比公元1546年问世的欧洲纽伦堡药典《科德药方书》早887年。该书无论在内容和编写形式上都有新的突破，全面总结了唐以前的药物学成就，并很快流传于海内外，对后世医药学的发展影响极大。《本草经集注》（E错）：为魏晋南北朝本草代表作。作者为陶弘景。在序例部分除对《本经》条文逐一注释、发挥外，又补充了大量采收、鉴别、炮制、制剂、合药取量、诸病通用药及服药食忌等内容，大大丰富了药学理论。该书第一次全面系统地整理、补充了《本经》，反映了魏晋南北朝时期的本草学成就，初步确立了综合性本草著作的编写模式。